川崎病急性期最佳治疗药物是
A. 丙种球蛋白
B. 糖皮质激素
C. 丙种球蛋白+阿司匹林
D. 阿司匹林
E. 糖皮质激素+阿司匹林

正确答案：C。丙种球蛋白+阿司匹林

解析：川崎病为自限性疾病，预后主要取决于冠脉病变，故其治疗重点为预防冠脉病变，减轻继发冠脉损伤。阿司匹林可控制炎症、对抗血小板聚集；丙球早期（10天以内）应用，可迅速退热，预防冠脉病变，应同时合并应用阿司匹林（P166），因此，丙种球蛋白+阿司匹林（C对）为最佳治疗方案。单用丙种球蛋白（A错）或阿司匹林（D错）的效果差于二者联合。糖皮质激素（BE错）不作为首选，因其可增加血液粘稠度，有继发血栓形成的风险。